属于三环类抗抑郁药的是
A. 雷尼替丁
B. 奥美拉唑
C. 阿米替林
D. 度洛西汀
E. 氟西汀

正确答案：C。阿米替林

解析：本题考查抗抑郁药。三环类抗抑郁药（TCAs）包括丙咪嗪、阿米替林（C对）、多塞平等。雷尼替丁（A错）为抑制胃酸的H₂受体阻断剂。奥美拉唑（B错）为抑制胃酸的质子泵抑制剂。度洛西汀（D错）为5-羟色胺和去甲肾上腺素再摄取抑制剂。氟西汀（E错）为5-羟色胺再摄取抑制剂。